直接影响活动效率，使活动顺利完成的个性心理特征是
A. 人格
B. 能力
C. 气质
D. 性格
E. 动机

正确答案：B。能力

解析：本题考查能力。直接影响活动效率，使活动顺利完成的个性心理特征是（B对）。 人格（A错）是指一个人的整个精神面貌，具有一定倾向性的、稳定的心理特征的总和。气质（C错）典型的、稳定的心理活动的动力特性，它主要表现在人的心理活动的动力方面，如心理活动过程的速度和灵活性（如知觉的速度、思维的灵活度、注意集中时间的长短等）；强度（如情绪的强弱、意志努力的程度等）；以及心理活动的指向性（倾向于外部事物或倾向于内部体验）。性格（D错）是个体在生活过程中形成，对客观现实稳固的态度以及与之相适应的习惯了的行为方式；它是一个人的心理面貌本质属性的独特结合，是人与人相互区别的主要方面。动机（E错）是引起和维持个体的活动，并使活动朝着一定目标的内部心理动力；动机和人们的需要有着密切的联系，需要是动机的基础和根源，动机是推动人们活动的直接原因。